《医疗事故处理条例》规定，对60周岁以上的患者因医疗事故致残的，赔偿其残疾生活补助费的时间不超过
A. 5年
B. 10年
C. 15年
D. 20年
E. 30年

正确答案：C。15年

解析：《医疗事故处理条例》第五章第五十条规定：（五）残疾生活补助费：根据伤残等级，按照医疗事故发生地居民年平均生活费计算，自定残之月起最长赔偿30年（E错）；但是，60周岁以上的，不超过15年（C对）；70周岁以上的，不超过5年（A错）。